以下改善维生素C注射剂稳定性的措施中，不正确的做法是
A. 加入抗氧剂BHA或BHT
B. 通惰性气体二氧化碳或氮气
C. 调节pH至6.0～6.2
D. 采用100℃，流通蒸汽15min灭菌
E. 加EDTA-2Na

正确答案：A。加入抗氧剂BHA或BHT

解析：本题考查提高注射剂稳定性的方法。以下改善维生素C注射剂稳定性的措施中，不正确的做法是加入抗氧剂BHA或BHT（A错，为本题正确答案）。维生素C注射液是水溶性溶液，抗氧剂BHA（叔丁基对羟基茴香醚）和BHT（2,6-二叔丁基羟基甲苯）为油溶性抗氧剂，故不宜使用。制备：在配制容器中加处方量80%的注射用水，通二氧化碳饱和，加维生素C溶解后，分次缓缓加入碳酸氢钠，搅拌使完全溶解，加入预先配制好的依地酸二钠溶液（E对）和亚硫酸氢钠溶液，搅拌均匀，调节药液pH6.0～6.2（C对），添加二氧化碳饱和的注射用水至足量。用垂熔玻璃漏斗与膜滤器过滤，溶液中通二氧化碳，并在二氧化碳或氮气流下灌封（B对），用100℃流通蒸汽灭菌15分钟（D对）。